用于类风湿性关节炎治疗的选择性环氧酶-2（COX-2）抑制剂是
A. 舒林酸
B. 塞来昔布
C. 吲哚美辛
D. 布洛芬
E. 萘丁美酮

正确答案：B。塞来昔布

解析：本题考查塞来昔布。塞来昔布（B对）为非羧酸类抗炎药，属于昔布类，是一种选择性环氧酶-2（COX-2）抑制剂，用于类风湿性关节炎治疗；舒林酸（A错）为非甾体抗炎药；吲哚美辛（C错）是芳基乙酸类抗炎药；布洛芬（D错）是芳基丙酸类药物；萘丁美酮（E错）是芳基丙酸类抗炎药。